可被肝药酶CYP2C9和CYP3A4代谢，代谢产物仍具降压活性的ARB类药物是
A. 福辛普利
B. 缬沙坦
C. 厄贝沙坦
D. 氯沙坦
E. 卡托普利

正确答案：D。氯沙坦

解析：本题考查氯沙坦。可被肝药酶CYP2C9和CYP3A4代谢，代谢产物仍具降压活性的ARB类药物是氯沙坦（D对）。福辛普利（A错）属于血管紧张素转换酶抑制剂，适用于治疗高血压和心力衰竭。缬沙坦（B错）属于ARB类药物，适用于伴慢性心力衰竭、心肌梗死后伴心功能不全、糖尿病肾病、非糖尿病肾病、代谢综合征、蛋白尿或微量白蛋白尿患者的降压治疗。厄贝沙坦（C错）属于血管紧张素Ⅱ受体阻断剂，适用于治疗原发性高血压。卡托普利（E错）为非肽类血管紧张素转化酶抑制剂，临床用于高血压，心力衰竭，高血压急症。